《中华人民共和国药品管理法》规定，销售地道中药材必须标明
A. 产地
B. 药理活性
C. 化学成分
D. 杂质含量
E. 储存条件

正确答案：A。产地

解析：本题考查地道中药材销售。《中华人民共和国药品管理法》规定，销售地道中药材必须标明产地（A对）。发运中药材必须有包装。在每件包装上，必须注明品名、产地、日期、调出单位，并附有质量合格的标志。不同地方产出的中药材其有效成分含量不一定相同，导致使用剂量也不相同，在销售地道中药材时，必须注明产地使消费者便于识别，如有需要，销售者还需加以解释说明。